男，73岁。右上肺癌根治术后第5天突发高热，胸腔闭式引流管内持续大量气体逸出。胸部X线片示：右侧液气胸。最可能的原因是
A. 食管破裂
B. 支气管胸膜瘘
C. 肺边缘漏气
D. 自发性气胸
E. 肺大泡破裂

正确答案：B。支气管胸膜瘘

解析：患者老年男性，肺癌术后（支气管胸膜瘘多有前期胸部手术或外伤诱因）出现高热，胸腔闭式引流管内持续大置气体溢出（支气管胸膜瘘常见症状）。胸部X线片示：右侧液气胸（支气管胸膜瘘常见影像学表现），该患者初步诊断为支气管胸膜瘘（B对）；食管破裂（A错）可发生于钝性损伤、锐器伤及火器伤，也可因剧烈呕吐致自发性食管破裂，主要症状常表现为呕血。自发性气胸（D错）及肺大泡破裂（E错）常表现为胸闷、气短等呼吸困难症状，一般不引起发热。